在真核生物中，经RNA聚合酶Ⅱ催化产生的转录产物是
A. mRNA
B. 18S rRNA
C. 28S rRNA
D. tRNA
E. 全部RNA

正确答案：A。mRNA